下列哪些情况可发生首过效应
A. 胃酸对药物的破坏
B. 药物在肠黏膜经酶的灭活
C. 药物与血浆蛋白的结合
D. 口服后药物经门静脉到肝脏被转化
E. 注射部位的吸收

正确答案：B、D。药物在肠黏膜经酶的灭活；口服后药物经门静脉到肝脏被转化

解析：本题考查首过效应。药物在肠黏膜经酶的灭活（B对）或口服后经门静脉到肝脏被转化（D对）这两种情况下均发生首过效应。胃酸对药物的破坏（A错）是发生在吸收前的变化；药物与血浆蛋白呈可逆性结合（C错），结合型药物暂无生物效应，又不被代谢排泄，在血液中暂时贮存；皮下或肌内注射（E错），药物先沿结缔组织扩散，再经毛细血管和淋巴内皮细胞进入血液循环。